不能除去热原的方法是
A. 高温法
B. 酸碱法
C. 冷冻干燥法
D. 吸附法
E. 反渗透法

正确答案：C。冷冻干燥法

解析：本题考查去除热原的方法。冷冻干燥法（C错，为本题正确答案）是指将待干燥物快速冻结后，再在高真空条件下将其中的冰升华为水蒸气而去除的干燥方法，不能用于去除热原。高温法（A对）适用于耐高温的容器和用具除去热原。酸碱法（B对）适用于耐酸碱的玻璃容器、瓷器或塑料制品除去热原。吸附法（D对）中活性炭是常用的吸附剂。反渗透法（E对）是通过三醋酸纤维素膜或聚酰胺膜除去热原。